患儿，1岁。阵发性痉挛性咳嗽1个半月，经治疗咳嗽减轻，已少痰，容易出汗，舌红苔少，治疗应首选
A. 牧蛎散
B. 桑白皮汤
C. 加味泻白散
D. 沙参麦门冬汤
E. 人参五味子汤

正确答案：D。沙参麦门冬汤

解析：患儿阵发性痉挛性咳嗽，当属百日咳，其病已1个半月，经治疗咳嗽减轻，但其日久不愈，耗伤气阴，则见少痰，容易出汗，舌红苔少为肺阴亏虚之象，治以沙参麦门冬汤，可养阴润肺，兼清余热（D对）。牡蛎散适于自汗、盗汗证（A错）。桑白皮汤善于肺经热甚，喘嗽痰多等实证（B错）。加味泻白散主治恼怒伤肝，木火刑金，内伤腋痛（C错）。人参五味子汤适于肺脾气虚的肺炎喘嗽，多见于肺炎的恢复期，以咳嗽无力，动则汗出为主要证候（E错）。